湖泊水库的水体富营养化现象称之为
A. 赤潮
B. 水华
C. 水质发黑
D. 形成岸边污染带
E. 水生生物大量繁殖

正确答案：B。水华

解析：本题考查湖泊水库的水体富营养化现象。当湖泊、水库水接纳过多含磷、氮的污水时，可使藻类等浮游生物大量繁殖形成水体富营养化。由于占优势的浮游生物的颜色不同，水面往往呈现红色、绿色、蓝色等，这种情况出现在淡水中时称为水华（B对ACDE错）。